某女，40岁，既往罹患尿路感染，反复发作，清明时节，因风热，不但又发疟疾，而且引发咳嗽吐痰。刻下尿频、尿急、尿痛、尿黄，咳嗽痰多，二黄，证属于热阻肺，湿热下注。治当利尿通淋，清肺化痰，宜选用的药是
A. 瞿麦
B. 通草
C. 连钱草
D. 冬葵子
E. 车前子

正确答案：E。车前子

解析：本题考查的是车前子的功效。治当利尿通淋，清肺化痰，宜选用的药是车前子（E对）。车前子：【功效】利水通淋，渗湿止泻，明目，清肺化痰。瞿麦（A错）：【功效】利尿通淋，破血通经。通草（B错）：【功效】利水清热，通气下乳。连钱草（C错）：【功效】利湿通淋，清热解毒，散瘀消肿。冬葵子（D错）：【功效】利水通淋，下乳，润肠通便。